提示正气渐复的舌象表现是
A. 舌苔由白转黄
B. 舌苔由厚转薄
C. 舌苔由薄转厚
D. 舌苔由燥变润
E. 舌苔由润变燥

正确答案：B。舌苔由厚转薄

解析：舌苔由厚转薄，为舌苔消，提示正气胜邪，或内邪消散外达，为病退的征象（B对）。舌苔由白转黄，或呈黄白相兼，多为外感表证处于化热入里，表里相兼阶段（A错）。舌苔由薄转厚，为舌苔长，提示邪气渐盛，或表浅入里，为病进（C错）。舌苔由燥转润，主热退津复，或饮邪始化（D错）。舌苔由润变燥，表示热重津伤，或津失输布（E错）。